影响人群健康状况的因素包括
A. 社会因素
B. 自然因素
C. 生物因素
D. A和B
E. 上述A、B、C三项

正确答案：E。上述A、B、C三项